下列关于统计图的制作的叙述，不正确的是
A. 纵横轴的比例一般为5∶7或7∶5
B. 标题一般放在图的正下方
C. 绘图时纵轴必须是算术刻度
D. 通常需附图例说明不同事物的指标大小
E. 纵、横轴的刻度值应按从小到大的顺序排列

正确答案：C。绘图时纵轴必须是算术刻度